以下检测方法中，不能确定目前存在幽门螺杆菌感染的是
A. 胃黏膜组织染色
B. 快速尿素酶试验
C. 幽门螺杆菌培养
D. ¹³C或¹⁴C尿素呼气试验
E. 血清抗幽门螺杆菌抗体测定

正确答案：E。血清抗幽门螺杆菌抗体测定